主动转运的特点描述错误的是
A. 逆浓度
B. 不消耗能量
C. 有饱和性
D. 与结构类似物可发生竞争
E. 有部位特异性

正确答案：B。不消耗能量

解析：本题考查药物的转运方式。主动转运是指借助载体或酶促系统，可以从膜的低浓度一侧向高浓度一侧转运（A对），需要消耗能量（B错，为本题正确答案）；主动转运需要借助载体，故有部位特异性（E对）和饱和性（C对），其结构类似物还可与其发生竞争（D对）。